人参中化学成分的结构类型主要有
A. 人参二醇型
B. 人参三醇型
C. 莨菪烷型
D. 黄烷型
E. 齐墩果酸型

正确答案：A、B、E。人参二醇型；人参三醇型；齐墩果酸型

解析：本题考查的是人参的化学成分。人参中化学成分的结构类型主要有人参皂苷二醇型（A对）、人参皂苷三醇型（B对）、齐墩果烷型（E对）。人参含有皂苷、多糖和挥发油等多种化学成分，人参皂苷为人参的主要有效成分之一。《中国药典》以人参皂苷为指标成分对人参、红参和人参叶进行含量测定。其中，人参和红参的质量控制成分为人参皂苷Rg₁、人参皂苷Re和人参皂苷Rb₁。例如，要求人参中人参皂苷Rg₁和人参皂苷Re的总量不得少于0.30%，人参皂苷Rb₁不得少于0.20%。人参皂苷可以分为三类，分别是人参皂苷二醇型（A型）、人参皂苷三醇型（B型）和齐墩果烷型（C型）。